以医院为基础的病例对照研究相比，队列研究的主要优点是
A. 能够明确因果联系
B. 易于获得更具代表性的总体
C. 易于获得非暴露组的观察对象
D. 可直接估计所研究疾病的发生率
E. 省钱、省时

正确答案：D。可直接估计所研究疾病的发生率

解析：本题考查队列研究的最大优点。队列研究的最大优点就在于它可以直接计算出研究对象的结局的发生率（D对ABCE错），因而也就能够直接计算出相对危险度和归因危险度，从而可直接评价暴露的效应。